可以在经批准的普通商业企业零售的药品是
A. 处方药
B. 非处方药
C. 乙类非处方药
D. 甲类非处方药
E. 传统药

正确答案：C。乙类非处方药

解析：本题考查普通商业企业零售。可以在经批准的普通商业企业零售的药品是非处方药（C对）。《处方药与非处方药流通管理暂行规定》第五章普通商业企业零售第十九条：在药品零售网点数量不足、布局不合理的地区，普通商业企业可以销售乙类非处方药，但必须经过当地地市级以上药品监督管理部门审查、批准、登记，符合条件的颁发乙类非处方药准销标志。具体实施办法由省级药品监督管理部门制定。根据便民利民的原则，销售乙类非处方药的普通商业企业也应合理布局。鼓励并优先批准具有《药品经营企业许可证》的零售药店与普通商业企业合作在普通商业企业销售乙类非处方药。第二十条：普通商业企业不得销售处方药（A错）和甲类非处方药（BD错），不得采用有奖销售、附赠药品或礼品销售等销售方式销售乙类非处方药，暂不允许采用网上销售方式销售乙类非处方药。